可以不隔离传染源的传染病是
A. 麻疹
B. 传染性非典型肺炎
C. 人感染高致病性禽流感
D. 艾滋病
E. 伤寒和副伤寒

正确答案：D。艾滋病